全身骨与关节结核中发病率最高的是
A. 髋关节结核
B. 膝关节结核
C. 脊柱结核
D. 肘关节结核
E. 肩关节结核

正确答案：C。脊柱结核

解析：识记内容。骨与关节结核是最常见的肺外继发性结核，其中脊柱结核（C对）约占50%，最多见，其次为膝关节结核（B错）和髋关节结核（A错）各占约15%，肘关节（D错）和肩关节（E错）结核较少见。